苯二氮䓬类药物过量或者中毒，特异性解救药物是
A. 氟奋乃静
B. 新斯的明
C. 碘解磷定
D. 氟马西尼
E. 尼可刹米

正确答案：D。氟马西尼

解析：本题考查苯二氮䓬类药物中毒解救。苯二氮䓬类药物过量或者中毒，特异性解救药物是氟马西尼（D对）。氟马西尼是特异性苯二氮䓬受体阻断剂，能快速逆转昏迷，首次静脉注射剂量为0.3mg。碘解磷定（C错）适用于有机磷类中毒的解救。尼可刹米（E错）适用于中枢性呼吸及循环衰竭、麻醉药及其他中枢抑制药中毒的解救。